心衰时心肌及间质在结构、功能和细胞表型等方面所出现的适应性变化，称为
A. 紧张性扩张
B. 肌源性扩张
C. 向心性肥大
D. 心室僵硬度
E. 心室重塑

正确答案：E。心室重塑

解析：慢性心衰时，心脏发生慢性综合性代偿适应性反应，称为心室重塑（E对）。心室重塑包括心肌细胞重塑、心肌间质重塑。心肌细胞重塑时，心肌发生肥大（结构改变），心脏收缩力增加（功能改变），室壁张力降低，维持心排血量。心肌的结构改变除了肥大以外，还有细胞表型改变（心肌所合成的蛋白质的种类变化），发生表型改变的心肌细胞在线粒体、肌原纤维等方面与正常心肌细胞有差异，从而导致其代谢与功能发生变化。